清气与水谷之气结合关系到
A. 卫气的生成
B. 营气的生成
C. 宗气的生成
D. 元气的生成
E. 中气的生成

正确答案：C。宗气的生成

解析：宗气的生成有两个来源：一是脾胃运化的水谷之精所化生的水谷精气，一是肺从自然界中吸入的清气，两者结合生成宗气（C对）。卫气是水谷精气中慓疾滑利的部分所生成（A错）；营气来源于脾胃运化之水谷精微，由水谷精微中的精华部分（B错）；元气是由先天精气为主所化生（D错）；中气由脾胃功能生成（E错）。